含漱剂
A. 严禁直接口服
B. 禁用于红肿部位
C. 使用后不宜马上饮水
D. 一般应整片吞服
E. 保持舌下含服至少5分钟，仰卧姿势约20分钟

正确答案：C。使用后不宜马上饮水

解析：本题考查含潄剂的正确使用。含漱剂使用后不宜马上饮水（C对）。含漱剂多为水溶液，使用时宜注意：①含漱剂中的成分多为消毒防腐药，含漱时不宜咽下或吞下；②对幼儿、恶心、呕吐者暂时不宜含漱；③按说明书的要求稀释浓溶液；④含漱后不宜马上饮水和进食，以保持口腔内药物浓度。泡腾片严禁直接服用或口含（A错）。使用透皮贴剂时宜注意：皮肤有破损、溃烂、渗出、红肿的部位不要贴敷（B错）。服用缓、控释制剂的药片或胶囊时，除另有规定外，一般应整片或整丸吞服（D错），严禁嚼碎和击碎分次服用。舌下片含服时间一般控制在5min左右（E错）。